邪热内盛，深伏于里，阳气被遏，不能外达，手足厥冷属于
A. 阳损及阴
B. 阳盛格阴
C. 阴盛格阳
D. 阴损及阳
E. 阴阳脱失

正确答案：B。阳盛格阴

解析：阳盛格阴，指阳气偏盛至极，壅遏于内，排斥阴气于外，表现为壮热，面红，气粗，烦躁，舌红，脉洪大有力，但手足厥冷（B对）；阳损及阴指由于阳气虚损，无阳则阴无以生，从而在阳虚的基础上又导致阴虚，形成以阳虚为主的阴阳两虚的病机变化（A错）；阴盛格阳指阳气极虚，导致阴寒之气偏盛，壅闭于里，逼迫阳气浮越于外，而出现内真寒外假热的病机变化（C错）；阴损及阳指由于阴气亏损，累及阳气生化不足，或阳气无所依附而耗散，从而在阴虚的基础上又出现延续，形成以阴虚为主的阴阳两虚的病机变化（D错）；阴阳脱失指机体的阴气和阳气突然大量的脱失，导致生命垂危的病机变化（E错）。